女，16岁，持续高热一周近日伴腹痛、腹泻。体检：肝肋下2cm，质软，脾肋下2cm。经3天有效抗生素治疗，体温下降，腹泻中止，此时最合适的处理是
A. 小剂量激素治疗
B. 继续抗生素治疗全程共2周
C. 保持大便通畅
D. 补液利尿有助于毒素排泄
E. 绝对卧床休息

正确答案：B。继续抗生素治疗全程共2周